法洛氏四联症，不应存在下述哪种
A. 肺动脉狭窄
B. 右心室肥大
C. 室间隔缺损
D. 主动脉骑跨
E. 动脉血氧饱和度大于95%

正确答案：E。动脉血氧饱和度大于95%

解析：法洛四联症由4种畸形组成：1.右心室流出道梗阻，其中常有肺动脉瓣环、肺动脉总干的发育不良和肺动脉分支的非对称性狭窄（A对）。2.室间隔缺损（C对）3.主动脉骑跨（D对）4.右心室肥厚（B对）。法洛氏四联症的患儿常有青紫、蹲踞症状等缺氧的表现，动脉血氧饱和度多小于95%（E错，为本题正确答案）。